目前使用的流行性乙型脑炎疫苗属于
A. 减毒活疫苗
B. 灭活疫苗
C. 基因工程疫苗
D. 亚单位疫苗
E. 温度敏感株疫苗

正确答案：B。灭活疫苗

解析：病毒的灭活疫苗：主要有脊髓灰质炎灭活疫苗（或称Salk疫苗）、乙型脑炎灭活疫苗、人用狂犬病灭活提纯疫苗。肾综合征出血热灭活疫苗、森林脑炎灭活疫苗、甲型肝炎灭活疫苗等。掌握“病毒感染检查方法及防治原则”知识点。